病死率的定义是
A. 某人群中死于某病的患者频率
B. 每10万人口中因某病死亡的频率
C. 患某病的住院病人中因该病而死亡的频率
D. 一定时期内，患某病的病人中因该病而死亡的比值
E. 特殊原因引起的某病死亡

正确答案：D。一定时期内，患某病的病人中因该病而死亡的比值